与盐酸氯胺酮描述不相同的是
A. 属于Ⅱ类精神药品
B. 水溶液不能和弱碱性药物溶液混合使用
C. 右旋体会产生噩梦和幻觉等副作用
D. N-去甲基的代谢产物仍有活性
E. 产生分离麻醉作用

正确答案：A。属于Ⅱ类精神药品